泡腾片的崩解时限是
A. 3分钟
B. 5分钟
C. 15分钟
D. 30分钟
E. 60分钟

正确答案：B。5分钟

解析：本题考查片剂的崩解时限。中国药典规定，泡腾片的崩解时限为5min（B对）；分散片、可溶片的崩解时限为3min（A错）；普通片剂为15min（C错）；薄膜衣片为30min（D错）；糖衣片应在1小时（E错）内全部崩解。